女，18岁。发热、鼻出血3天。查体：全身浅表淋巴结肿大，最大者2.5cm×2cm大小，胸骨压痛（+）.肝脾肋下均可触及边缘。骨髓细胞学检查：骨髓原始细胞占0.65，过氧化物酶（-），非特异酯酶染色（-）。最可能的诊断是
A. 急性早幼粒细胞白血病
B. 急性粒-单核细胞白血病
C. 急性单核细胞白血病
D. 急性淋巴细胞白血病
E. 急性红白血病

正确答案：D。急性淋巴细胞白血病

解析：患者青少年女性，发热、鼻出血3天（贫血、发热、出血是急性白血病正常骨髓造血功能受抑的表现），查体：全身浅表淋巴结肿大，肝脾肋下均可触及边缘（肝脾轻度肿大），胸骨压痛（+）（白血病细胞浸润可使肝、脾、淋巴结肿大，胸骨压痛，淋巴结肿大以ALL较多见，肝脾肿大多为轻至中度），骨髓细胞学检查：骨髓原始细胞占0.65（骨髓原始细胞≥骨髓有核细胞（ANC）的30%（FAB分型）或≥20%（WHO分型）即可诊断为急性白血病），提示急性白血病，过氧化物酶（-）（主要见于急性淋巴细胞白血病），非特异酯酶染色（-）（主要见于急性淋巴细胞白血病），故患者最可能的诊断为急性淋巴细胞白血病（D对）。急性早幼粒细胞白血病（A错）淋巴结肿大少见，过氧化物酶染色强阳性，非特异酯酶染色可阳性，不能被NaF抑制；急性粒-单核细胞白血病（B错）过氧化物酶染色阳性，非特异酯酶染色阳性；急性单核细胞白血病（C错）过氧化物酶染色可阳性，非特异酯酶染色阳性，可被NaF抑制；急性红白血病（E错）糖原染色强阳性。